下列不属于龋病病因范畴的是
A. 细菌和牙菌斑
B. 食物
C. 宿主
D. 时间
E. 创伤

正确答案：E。创伤

解析：本题考查四联因素学说。创伤可导致牙髓病、根尖周病、牙周组织创伤等口腔疾病，不属于龋病发生的范畴（E错，为本题的正确答案）。龋病是一种多因素疾病，只有多种因素相互作用才可导致龋病的发生，包括细菌和牙菌斑（A对）、食物（B对）、宿主（C对）和时间（D对）。